腹痛、腹泻、黏液脓血便伴发热恶寒，最可能的诊断是
A. 细菌性痢疾
B. 阿米巴痢疾
C. 急性胃肠炎
D. 流行性脑脊髓膜炎
E. 霍乱

正确答案：A。细菌性痢疾

解析：细菌性痢疾（A对）的主要表现为发热恶寒、腹痛、腹泻、里急后重、排黏液脓血便；阿米巴痢疾（B错）多不发热，有红色果酱样便；急性胃肠炎（C错）主要表现为恶心、呕吐、腹痛、腹泻，大便为黄色或黄绿色；流行性脑脊髓膜炎（D错）无腹痛、腹泻、黏液脓血便；霍乱（E错）主要表现为呕吐腹泻无黏液脓血便。